下列关于刀晕的处理，错误的是
A. 刀晕轻症，只要扶持患者安静平卧，室温保暖即可
B. 头位稍低，安静卧床
C. 给饮开水或糖水
D. 灸百会、水沟或刺合谷、少商等穴救治
E. 应迅速做完手术，进行急救

正确答案：E。应迅速做完手术，进行急救

解析：外科中如出现刀晕应该正确处理。刀晕轻症，只要扶持患者安静平卧，室温保暖即可（A错）。嘱头位稍低，安静卧床（B错）。给患者饮开水或糖水（C错）。灸百会、水沟或刺合谷、少商等穴救治（D错）。应立即停止手术，进行急救（E对）。